30岁，既往体健，无癫痫病史，怀孕8个月，突然出现抽搐，从小腹开始，发展至全身，口唇发绀、意识丧失，诊断为子痫，应选用的治疗方法是
A. 50%葡萄糖注射液湿敷
B. 50%硫酸镁溶液口服
C. 25%硫酸镁注射液稀释后静脉注射
D. 5%氯化钙注射液静脉滴注
E. 50%硫酸镁溶液湿敷

正确答案：C。25%硫酸镁注射液稀释后静脉注射

解析：本题考查硫酸镁剂型与给药途径的选择。25%硫酸镁注射液稀释后静脉注射（C对）可用于治疗子痫。药物剂型的选择与临床疗效和给药途径密切相关，不同的给药途径药物作用也不同。例如硫酸镁静脉注射可用于治疗子痫，而口服则用于导泻，湿敷则消肿。